初级卫生保健的具体任务不包括
A. 健康教育
B. 健康促进
C. 疾病的基本治疗
D. 疾病的三级预防
E. 发展疾病监测网络

正确答案：E。发展疾病监测网络

解析：本题考查初级卫生保健的具体任务。初级卫生保健的具体任务包括：①针对当前流行的卫生问题及其预防控制方法开展宣传教育（A对）；②促进食品供应和适当的营养（B对）；③供应充足的安全饮用水和基本卫生设施；④妇女儿童保健，包括计划生育；⑤针对主要传染病开展免疫接种；⑥预防和控制地方病；⑦常见病和伤害的妥善治疗（C对）和管理；⑧提供基本药物（D对）。发展疾病监测网络（E错，为本题正确答案）不是初级卫生保健的具体任务。